有关膜剂的表述，不正确的是
A. 膜剂的给药途径较多，但不能用作皮肤创伤的覆盖
B. 膜剂的种类有单层膜、多层膜和夹心膜
C. 合成高分子成膜材料的成膜性能优于天然高分子物质
D. 膜剂的外观应完整光洁，无明显气泡
E. 膜剂由主药、成膜材料和附加剂组成

正确答案：A。膜剂的给药途径较多，但不能用作皮肤创伤的覆盖